将处方部分药材细粉与其余药料制得的稠膏经加工制成的中药片剂称为
A. 分散片
B. 全浸膏片
C. 全粉末片
D. 半浸膏片
E. 提纯片

正确答案：D。半浸膏片